以下哪项不是牙齿酸蚀症的预防措施
A. 多吃些酸性物质
B. 治疗可引起牙酸蚀症的疾病
C. 增强牙对酸的抵抗力
D. 避免酸性环境中与酸的接触
E. 减少饮食中的酸对牙的侵蚀

正确答案：A。多吃些酸性物质

解析：针对于牙齿酸蚀症的预防措施：加强口腔健康教育、治疗可引起牙酸蚀症的疾病、减少饮食中的酸对牙的侵蚀、避免酸性环境中与酸的接触、增强牙对酸的抵抗力、改变不良的饮食习惯及口腔卫生习惯。掌握“酸蚀症的预防”知识点。